患者心力衰竭加重而发生水钠潴留时，应选用的利尿剂是
A. 卡维地洛
B. 氢氯噻嗪
C. 呋塞米
D. 比索洛尔
E. 地高辛

正确答案：C。呋塞米

解析：本题考查利尿药。患者心力衰竭加重而发生水钠潴留时，应选用的利尿剂是呋塞米（C对）。呋塞米、托拉塞米、布美他尼作为一类强效利尿药适用于大部分心力衰竭患者，特别适用于有明显液体潴留或伴肾功能受损的患者。卡维地洛（A错）为α、β受体阻断剂，阻断受体的同时具有舒张血管作用，用于治疗轻度及中度高血压或伴有肾功能不全、糖尿病的高血压患者。氢氯噻嗪（B错）为噻嗪类利尿剂，适用于有轻度液体潴留、伴高血压而肾功能正常的心力衰竭患者。比索洛尔（D错）和地高辛（E错）均为抗心力衰竭药。